不属于隐蔽抗原的组织成分
A. 脑组织
B. 晶状体蛋白
C. 精子
D. 甲状腺球蛋白
E. 关节滑膜

正确答案：E。关节滑膜

解析：由于解剖位置特殊，机体内某些抗原从胚胎期开始从未与机体免疫系统接触，称为隐蔽抗原。隐蔽抗原通常不引发自身免疫反应，这类抗原有脑组织（A对）、晶状体（B对）、睾丸、精（卵）子（C对）、甲状腺球蛋白（D对）和中枢神经系统的抗原等。但在外伤、感染、手术、烧伤等外界因素作用下，隐蔽抗原可释放出来，进入血液和淋巴管，被免疫系统识别，发生免疫应答，导致自身免疫疾病。关节滑膜（E错，为本题正确答案）与关节囊液接触，关节囊液与机体免疫系统接触，故关节滑膜不属于隐蔽抗原的组织成分。